中年男性患者，近两周来出现头晕乏力，鼻腔出血等症，查体：颈部浅表淋巴结肿大，下肢少许瘀斑。白细胞16.6×109/L，原始细胞0.60，血红蛋白80g/L，血小板34×109/L。体检中应特别注意的体征是
A. 睑结膜苍白
B. 胸骨压痛
C. 心脏杂音
D. 皮肤出血点
E. 浅表淋巴结肿大

正确答案：B。胸骨压痛

解析：急性白血病患者可有贫血、发热、出血等正常骨髓造血功能受抑表现，还可有淋巴结和肝脾大、骨骼和关节、眼、口、皮肤、中枢神经系统、睾丸病变等白血病细胞增殖浸润的表现，其中骨骼和关节病变中常出现白血病较典型体征胸骨压痛。掌握“急性白血病”知识点。